关于阿片类药物临床使用的说法，正确的有
A. 阿片类镇痛药物与阿托品合用会增加麻痹性肠梗阻的风险
B. 老年患者由于清除缓慢、血浆半衰期延长，因此使用阿片类镇痛药物会增加其呼吸抑制风险
C. 阿片类镇痛药物均能透过胎盘屏障，成瘾产妇的新生儿出生时可出现戒断症状
D. 阿片类镇痛药物可引起胃肠道蠕动减缓，使甲氧氯普胺效应减弱
E. 阿片类镇痛药物与硫酸镁注射液合用可减少中枢抑制，降低呼吸抑制的风险

正确答案：A、B、C、D。阿片类镇痛药物与阿托品合用会增加麻痹性肠梗阻的风险；老年患者由于清除缓慢、血浆半衰期延长，因此使用阿片类镇痛药物会增加其呼吸抑制风险；阿片类镇痛药物均能透过胎盘屏障，成瘾产妇的新生儿出生时可出现戒断症状；阿片类镇痛药物可引起胃肠道蠕动减缓，使甲氧氯普胺效应减弱

解析：本题考查阿片类药物。阿片类镇痛药与阿托品合用不仅加重便秘，还可增加麻痹性肠梗阻（A对）和尿潴留危险；儿童及老年患者清除缓慢，血浆半衰期长，用药时增加呼吸抑制风险（B对）；阿片类镇痛药均能透过胎盘屏障，成瘾产妇的新生儿出生时立即出现戒断症状（C对）；阿片类镇痛药可引起胃肠道蠕动减缓，使甲氧氯普胺效应减低（D对）；硫酸镁与阿片类镇痛药合用可增强中枢抑制，增加呼吸抑制（E错）。